类天疱疮可出现以下临床表现，除了
A. 皮肤水疱
B. 小口畸形
C. 尼氏征阳性
D. 剥脱性龈炎
E. 睑球结膜粘连

正确答案：C。尼氏征阳性

解析：本题考查类天疱疮的临床表现。类天疱疮是一类在临床上黏膜皮肤的厚壁张力性大疱为特征的疾病，临床表现为口腔、眼、皮肤、以及其他部位（咽、气管、食管等）的损害。尼氏征阳性是用手指侧向推压外观正常的皮肤或粘膜，即刻迅速形成水疱；推赶水疱能使其在皮肤上移动；在口腔内用舌舐及黏膜，可使外观正常的黏膜表层脱落或撕去的现象。天疱疮出现上皮内疱为尼氏征阳性，而类天疱疮出现上皮下疱不会出现此种现象，为尼氏征阴性（C错，为本题的正确答案）。类天疱疮皮肤出现红斑或在正常皮肤上出现张力性水疱（A对）。类天疱疮口腔损害为发生在口角区则因瘢痕粘连而致张口受限或小口畸形（B对），牙龈最典型的表现呈剥脱性龈炎（D对）样损害。类天疱疮眼部损害为病损反复发作后睑、球结膜间有少许纤维附着，往往相互粘连，此呈睑球结膜粘连（E对）。